男，20岁。1型糖尿病病史10年，平时每日4次胰岛素强化治疗。近2日发热，咽痛,食欲不振，进食少，自行停用胰岛素。晨起家属发现患者不能正确回答问题，急诊就诊，查体:T38.5°C,精神差，轻度脱水貌。实验室检查:血钠140mmol/L，血钾4.5mmol/L，血糖25mmol/L，血pH7.25，尿酮体（+++），该患者经胰岛素及补液治疗后尿量增加至40-50ml/h，为纠正电解质紊乱，需要采取的治疗是
A. 补碱、补钾、补钠治疗
B. 补碱、补钾治疗
C. 补钠、补钙治疗
D. 补碱.、补钠治疗
E. 补钾、补钠治疗

正确答案：E。补钾、补钠治疗

解析：患者男，20岁，1型糖尿病患者（酮症酸中毒好发人群），自行停用胰岛素（诱因）后出现意识障碍、轻度脱水，血糖25mmol/L（血糖正常值3.9～6.0mmol/L），尿酮体（+++），血pH 7.25（pH正常值7.35～7.45，＜7.35提示酸中毒），可诊断为糖尿病酮症酸中毒。补液是糖尿病酮症酸中毒治疗的关键环节，通常先使用生理盐水；治疗前的血钾水平不能真实反映体内缺钾程度，患者血钾在正常范围内，尿量＞40ml/h，应立即开始补钾；综上患者应采取的治疗措施为补钠、补钾治疗（E对C错）。DKA经输液和胰岛素治疗后，酮体水平下降，酸中毒可自行纠正，一般不必补碱，补碱指征为血pH<7.1（ABD错）。